有关腮腺咬肌区的描述中，错误的是
A. 前界为咬肌前缘
B. 后界为下颌骨后缘
C. 上为颧弓及外耳道
D. 下为下颌骨下缘
E. 内容包括腮腺及咬肌

正确答案：B。后界为下颌骨后缘

解析：腮腺咬肌区的境界前界为咬肌前缘，后界为胸锁乳突肌、乳突及二腹肌后腹的前缘，上为颧弓及外耳道，下以下颌骨下缘为界。掌握“腮腺咬肌区、腮腺与面神经解剖关系”知识点。